酚妥拉明可用于治疗
A. 支气管哮喘
B. 青光眼
C. 外周血管痉挛
D. 心律失常
E. 重症肌无力

正确答案：C。外周血管痉挛